禽流感的主要传染源是
A. 携带禽流感病毒的鸡鸭的粪便
B. 患流感病毒污染的鸡鸭的羽毛
C. 患禽流感或携带禽流感病毒的鸡鸭
D. 残留有禽流感病毒的病禽肉
E. 受禽流感病毒污染的水

正确答案：C。患禽流感或携带禽流感病毒的鸡鸭

解析：本题考查禽流感的主要传染源。禽流感的主要传染源是患禽流感或携带禽流感病毒的鸡鸭（C对ABDE错）。减少和控制禽类，尤其是家禽间的禽流感病毒的传播尤为重要。